女，30岁。月经不规律，自测基础体温高温相已持续22天，宫颈黏液涂片结果显示典型椭圆小体。该患者处于
A. 月经前期
B. 排卵后期
C. 接近排卵期
D. 早孕期
E. 月经期

正确答案：D。早孕期

解析：育龄期女性，月经不规律，基础体温持高温相22天（t＞黄体周期）。宫颈粘液涂片示典型椭圆小体（提示为孕激素作用下粘液结晶），诊断该患者处于早孕期。女性月经周期分为卵泡期和黄体期，前者包括月经期始前14天，后者为自排卵日开始的后14天。黄体有主要分泌孕激素，少量分泌雌二醇的作用，因此于排卵后一周循环中孕激素达到高峰，雌激素亦达到又一高峰。此时，若卵细胞未受精，因下丘脑-垂体-性腺轴中雌孕激素等的负反馈作用，二者循环中含量逐渐降低，黄体萎缩退化为白体，子宫内膜失去性激素支持剥脱从而进入月经期；若卵细胞受精成功，则黄体转化为妊娠黄体，维持循环中雌孕激素高水平状态。孕激素有兴奋下丘脑体温调节中枢，使基础体温升高0.3～0.5℃的作用，临床上可以此作为判定排卵日期的标志之一。该育龄女性月经不规律，高温相持续时期大于黄体期，高度提示循环中孕激素高水平状态，为早孕期（D对）。